影响片剂成型的因素不包括
A. 药物的可压性
B. 药物的熔点
C. 药物的结晶形态
D. 药物的密度
E. 颗粒中的含水量

正确答案：D。药物的密度